所示，取终寿区间成数a₀＝0.09。“15～”岁组的死亡人数d₁₅为
A. 113
B. 115
C. 109
D. 111
E. 125

正确答案：A。113

解析：本题考查死亡人数的计算。将本题中死亡人数代入公式可计算出“15～”岁组的死亡人数d₁₅＝96441×0.00117≈113（A对BCDE错）。